在队列研究中，控制信息偏倚的主要手段是
A. 在研究设计阶段利用限制和匹配的方法来控制
B. 提高调查诊断技术，精确测量，同等地对待每个研究对象
C. 提高研究对象的依从性
D. 严格按规定的标准选择对象
E. 以上都不是

正确答案：B。提高调查诊断技术，精确测量，同等地对待每个研究对象